WHO提出了不同健康政策阶段应采取的工具和手段，不包括
A. 建立执法支持框架
B. 制定统一的人力资源开发政策
C. 建立跨部委、跨部门的管理委员会及联合行动小组
D. 建立社区协商和公民审计委员会，构建伙伴关系平台
E. 建立一体化的预算财政体系以及贯穿各部门的信息评价体系

正确答案：A。建立执法支持框架

解析：本题考查WHO提出的不同健康政策阶段应采取的工具和手段。WHO提出的不同健康政策阶段应采取的工具和手段包括：①建立跨部委、跨部门的管理委员会及联合行动小组（C对）；②建立一体化的预算财政体系以及贯穿各部门的信息评价体系（E对）；③制定统一的人力资源开发政策（B对）；④建立社区协商和公民审计委员会，构建伙伴关系平台（D对）；⑤对决策进行诊断、分析和评价，对可能的健康影响进行评估；⑥建立立法支持框架。建立执法支持框架（A错，为本题正确答案）不属于WHO提出的不同健康政策阶段应采取的工具和手段。